属于血浆清蛋白的功能的是
A. 营养作用
B. 催化作用
C. 运输作用
D. 维持血浆正常的pH
E. 以上都正确

正确答案：E。以上都正确

解析：血浆蛋白质的功能：①维持血浆胶体渗透压；②维持血浆正常的pH；③运输作用；④免疫作用；⑤催化作用；⑥营养作用；⑦凝血、抗凝血和纤溶作用；⑧血浆蛋白质异常与临床疾病。掌握“血液成分及血浆蛋白”知识点。